结核分枝杆菌生物学特性的叙述，错误的是
A. 专性需氧菌
B. 营养要求高
C. 生长快速
D. 不形成芽胞
E. 常用罗氏培养基进行培养

正确答案：C。生长快速

解析：结核分枝杆菌不易着色，经齐一尼抗酸染色呈红色，无菌毛和鞭毛，不形成芽胞，现证明有荚膜。结核菌为专性需氧菌，营养要求高，生长缓慢，常用罗氏培养基进行培养，需3～4周后才形成颗粒状或菜花形的乳酪色的粗糙型菌落。掌握“结核、非结核分枝杆菌”知识点。